明确疳为小儿脾胃病的医家是
A. 钱乙
B. 陈文中
C. 刘昉
D. 曾世荣
E. 万全

正确答案：A。钱乙

解析：疳证其病变部位主要在脾胃，胃主受纳，脾主运化，若脾胃失健，生化乏源，则气血不足，津液亏耗，肌肤、筋骨、经脉、脏腑失于濡养，日久则形成疳证，《小儿药证直诀》提出疳为小儿脾胃病，为钱乙所作（A对）。南宋陈文中著《小儿痘疹方论》《小儿病源方论》，以擅用温补扶正见长，对痘疹类时行疾病因阳气虚寒而产生的逆证，用温补托毒急救（B错）。南宋刘昉的代表作为《幼幼新书》，是当时世界最完备的儿科学专著（C错）。元代曾世荣代表作为《活幼心书》，是中医新生儿学较早的集中论述，以调元散、补肾地黄丸治疗胎怯（D错）。明代万全首先提出“三有余，四不足”的小儿生理病理学说，在治疗方面首重保护胃气，其著作颇丰（E错）。